男，56岁。低热咳嗽，咳痰2周，胸部X线片示右肺下叶背段可见不规则斑片影及薄壁空洞。其内未见液平，血常规正常，ESR56mm/h。该患者首先考虑
A. 肺结核
B. 肺癌
C. 急性肺脓肿
D. 慢性支气管炎
E. 金黄色葡萄球菌肺炎

正确答案：A。肺结核

解析：男，56岁。低热咳嗽，咳痰2周应考虑肺结核。胸部X线片示右肺下叶背段（肺结核病影像病变多发生在上叶的尖后段、下叶的背段和后基底段）可见不规则斑片影及薄壁空洞，其内未见液平（活动性肺结核通常表现为边缘模糊不清的斑片状阴影，可有中心溶解或空洞，或出现播散病灶），ESR56mm/h（男性正常值0-15mm/h，提示患者出现感染）。综合该患者的病史、影像学检查、实验室检查，该患者诊断考虑为肺结核（A对）。肺癌（B错）的X线或CT表现为肺癌肿块常呈分叶状，有毛刺、切迹。癌组织坏死液化后，可形成偏心厚壁空洞。急性肺脓肿（C错）多有高热，咳大量脓臭痰。胸片表现为带有液平面的空洞伴周围浓密的炎性阴影。血白细胞和中性粒细胞增高。金黄色葡萄球菌肺炎（E错）起病多急骤，寒战、高热，体温多达39～40℃，胸痛，痰脓性，量多，带血丝或呈脓状。外周血白细胞计数增高、中性粒细胞比例增高，核左移。胸片X线检查显示肺段或肺叶实变，可早期形成空洞，或呈小叶状浸润，其中有单个或多发的液气囊腔。